溃疡性结肠炎患者最典型的症状是
A. 腹泻、腹痛、脓血便
B. 排便困难伴腹痛，无便血
C. 腹泻与便秘交替伴发热
D. 硬结便带血，便与血不混
E. 腹痛，便后可缓解，无便血

正确答案：A。腹泻、腹痛、脓血便

解析：溃疡性结肠炎患者最典型的症状是腹泻、腹痛、脓血便（A对），其中腹泻主要与炎症导致大肠黏膜对水、钠吸收障碍以及结肠运动功能失常有关，脓血便系炎症渗出、黏膜糜烂及溃疡导致。腹泻与便秘交替伴发热（C错）多见于肠结核（P368）。腹痛，便后可缓解，无便血（E错）可见于克罗恩病（P377）和肠易激综合征（P386）。